下列牙槽嵴低平者，可作为全口义齿主承托区的是
A. 前庭沟
B. 牙槽嵴舌侧斜面
C. 颊棚区
D. 下颌舌骨嵴
E. 牙槽嵴颊侧斜面

正确答案：C。颊棚区

解析：本题考查无牙颌的功能分区-主承托区。下列牙槽嵴低平者，可作为全口义齿主承托区的是颊棚区（C对）。颊棚区属于全口义齿的主承托区。前庭沟为全口义齿的边缘封闭区（A错）。牙槽嵴的唇、颊和舌腭侧斜面为全口义齿的副承托区（BE错）。下颌舌骨嵴为全口义齿的缓冲区（D错）。无牙颌的功能分区：1.主承托区：指垂直于（牙合）力方向的区域。包括牙槽嵴顶、腭穹窿的水平区、颊棚区等。此区的骨组织上覆盖的是咀嚼黏膜，有高度角化的复层鳞状上皮，其下有致密的黏膜下层所附着，能承担咀嚼压力，抵抗义齿基托的碰撞而不致造成组织的创伤。因此，全口义齿人工牙（尤其是后牙）应尽量不要偏离牙槽嵴顶，使咬合力垂直向作用于牙槽嵴顶主承托区。当牙槽嵴过度吸收成刃状或低平时，应减轻咬合力，并充分利用颊棚区和腭穹窿水平部分，增强组织的支持作用。2.副承托区：指与（牙合）力方向成角度的区域。包括上下颌牙槽嵴的唇、颊和舌腭侧斜面（不包括硬区），与主承托区之间无明显界限。3.边缘封闭区：是义齿边缘接触的软组织部分，如黏膜皱襞、系带附着部和下颌磨牙后垫。4.缓冲区：指需要缓冲咀嚼压力的区域。包括上颌隆突、颧突、上颌结节的颊侧、切牙乳突、下颌隆突、下颌舌骨嵴以及牙槽嵴上的骨尖、骨棱等部位。